男，40岁。恶心、呕吐尿色变深2天。既往无肝炎病史。查体；巩膜黄染，肝肋下2cm。实验室检查：ALT800U/L.TBil60μmoUL，抗HAVIgM（-），HBsAg（+）.抗HBs（-），抗HBclgM（+）该患者最可能的诊断是
A. 急性甲型肝炎
B. 急性肝炎，HBsAg携带者
C. 乙型肝炎恢复期
D. 甲型肝炎恢复期
E. 急性乙型肝炎

正确答案：E。急性乙型肝炎

解析：40岁男性患者，恶心、呕吐尿色变深2天（急性黄疸型肝炎临床表现），既往无肝炎病史，查体：巩膜黄染，肝肋下2cm（急性黄疸型肝炎体征）。实验室检查：ALT800U/L（正常参考值0～40U/L），TBil60μmol/L（正常参考值3.4～17.1μmol/L），抗HAVIgM（－）（无甲肝病毒感染）（AD错），HBsAg（+）（乙肝病毒感染），抗HBs（一）（急性感染期），抗HBcIgM（+）（急性感染），根据患者的病史、临床表现、体征及实验室检查，该患者最可能的诊断是急性乙型肝炎（E对BC错）。